二尖瓣狭窄心力衰竭合并快速心房颤动的首选治疗药物是
A. 维拉帕米
B. 洋地黄
C. 利多卡因
D. 地尔硫卓
E. 普罗帕酮

正确答案：B。洋地黄

解析：洋地黄为正性肌力药物，可增加心肌收缩力，用于治疗心力衰竭，还可以兴奋迷走神经，抑制心脏传导系统，减慢心室率，特别适合于伴有快速心房颤动的收缩期心力衰竭患者。因此二尖瓣狭窄心力衰竭合并快速心房颤动的首选治疗药物是洋地黄（B对）。维拉帕米（A错）和地尔硫䓬（D错）为非二氢吡啶类钙通道拮抗剂，常在洋地黄控制心室率不佳时使用（P289）。利多卡因（C错）主要用于急性心肌梗死或复发性室性快速性心律失常的治疗。普罗帕酮（E错）主要用于房颤患者转复窦性心律（P190），不能降低心室率。